含有苯丙噻吩结构，可用于治疗绝经后妇女骨质疏松症的药物是
A. 氯米芬
B. 萘替芬
C. 雷洛昔芬
D. 他莫昔芬
E. 特比萘芬

正确答案：C。雷洛昔芬

解析：本题考查选择性雌激素受体调节药的性质和代谢。雷洛昔芬（C对）含有苯丙噻吩结构，临床上主要用于治疗女性绝经后骨质疏松症。